为增加粘接力，粘接之前预备体表面需作处理，除了
A. 清洁
B. 干燥
C. 去油污
D. 酸蚀
E. 涂分离剂

正确答案：E。涂分离剂

解析：本题考查被粘物的表面预处理。为增加粘接力，粘接之前预备体表面需作处理，涂分离剂（E错，为本题的正确答案）却是相反的目的，为了使两个物体不粘接。清洁（A对）、干燥（B对）、去油污（C对）都是为了去除预备体表面不利于粘接的杂质，以免影响粘接效果。酸蚀（D对）可以提高物体的表面能，增加粘接面积，增加粘接力。